猩红热的主要临床表现不包括
A. 咽峡炎
B. 疹退后皮肤脱屑
C. 肌痛
D. 发热
E. 全身弥漫性红斑

正确答案：C。肌痛